鼻腭神经阻滞麻醉时一般的注射麻药量是
A. 0.25～0.5ml
B. 0.3～0.5ml
C. 0.5～1ml
D. 1～1.5ml
E. 1.5ml～2ml

正确答案：A。0.25～0.5ml

解析：鼻腭神经阻滞麻醉：将麻药注入腭前孔（切牙孔），以麻醉鼻腭神经，由于该处组织致密，注射麻药时需用较大压力，一般注入量为0.25～0.5ml。掌握“颌面部常用局麻法及牙拔除的麻醉选择”知识点。